关于病毒癌基因论述正确的是
A. 主要存在于朊病毒中
B. 在体外不能引起细胞转化
C. 感染宿主细胞能随机整合于宿主细胞基因组
D. 又称为原癌基因
E. 可直接合成蛋白质

正确答案：C。感染宿主细胞能随机整合于宿主细胞基因组

解析：存在于大部分生物的正常基因组中的癌基因又被称为细胞癌基因或原癌基因，存在于病毒中的被称为病毒癌基因（D错）。目前已发现的病毒癌基因有30多种，主要是RNA病毒，大多数是逆转录病毒，需经过逆转录才能合成蛋白质（E错）。以罗氏肉瘤病毒（RSV）为例：RSV感染宿主后，会以病毒RNA为模板，在逆转录酶催化下合成双链DNA的前病毒（A错），随后病毒DNA随机整合于宿主细胞基因组内（C对），通过重排或重组，将细胞中的原癌基因SRC导入了RSV基因组内，使RSV转变成为携带src的病毒，获得致癌能力。在一定条件下，病毒癌基因体外即可引起细胞转化（B错）。